处方书写大麻仁，应付
A. 大麻子
B. 胡麻子
C. 火麻仁
D. 蓖麻子
E. 亚麻子

正确答案：C。火麻仁